男性，40岁，渔民。因发热1周伴腹痛、腹胀、腹泻，大便每日3~4次，稀便有黏冻，村卫生室给服氯霉素5天，患者热退，症状好转，继续工作，2周后再次发热，体温39℃，抽血培养有伤寒杆菌生长。对伤寒带菌者有益的抗体是
A. “O”抗体
B. “Vi"抗体
C. “H”抗体
D. “O”与“Vi”抗体
E. “H”与“Vi”抗体

正确答案：B。“Vi"抗体